大怒易损伤的脏腑是
A. 心
B. 肺
C. 肾
D. 肝
E. 脾

正确答案：D。肝

解析：心在志为喜为惊，过喜或过惊 则伤心（A错）；肝在志为怒，过怒则伤肝（D对）；脾在志为思，过度思虑则伤脾（E错）；肺在志为悲为忧，过悲 则伤肺（B错）；肾在志为恐，过恐则伤肾（C错）。